左侧卧位听诊更明显的是
A. 二尖瓣狭窄舒张中晚期隆隆样杂音
B. 二尖瓣关闭不全收缩期吹风样杂音
C. 主动脉狭窄收缩期吹风样杂音
D. 主动脉瓣关闭不全舒张期叹气样杂音
E. 胸骨左缘第2肋间机器声样连续性杂音

正确答案：A。二尖瓣狭窄舒张中晚期隆隆样杂音

解析：左侧卧位听诊更明显的是二尖瓣狭窄舒张中晚期隆隆样杂音（A对）。二尖瓣关闭不全收缩期吹风样杂音于心尖区听诊最明显（B错）。主动脉狭窄收缩期吹风样杂音于胸骨右缘1～2肋间听诊最明显（C错）。主动脉瓣关闭不全舒张期叹气样杂音于上半身前倾坐位听诊更明显（D错）。胸骨左缘第2肋间机器声样连续性杂音见于动脉导管未闭（E错）。